根据《麻醉药品和精神药品管理办法实施条例》，抢救病人急需第一类精神药品而本医疗机构无法提供时，可以
A. 从其他医疗机构紧急借用
B. 从定点生产企业紧急借用
C. 要求患者找其他医疗机构购买使用
D. 对患者说明情况，请患者自行解决
E. 从邻近的戒毒单位紧急调用

正确答案：A。从其他医疗机构紧急借用

解析：本题考查麻醉药品和第一类精神药品借用和配置规。根据《麻醉药品和精神药品管理办法实施条例》，抢救病人急需第一类精神药品而本医疗机构无法提供时，可以从其他医疗机构紧急借用（A对）。医疗机构抢救患者急需麻醉药品和第一类精神药品而本医疗机构无法提供时，可以从其他医疗机构或者定点批发企业紧急借用；抢救工作结束后，应当及时将借用情况报所在地设区的市级药品监督管理部门和卫生主管部门备案。